不属于有机磷农药的是
A. 敌百虫
B. 乐果
C. DDV
D. 呋喃丹

正确答案：D。呋喃丹

解析：本题考查有机磷农药的分类。有机磷农药粗略分为磷酸酯类（P=O）和硫代磷酸酯类（P=S）二大类。再根据X的结构特征分为磷酸酯类（如敌敌畏（C对）、敌百虫（A对））、硫代磷酸酯类、磷酰胺及硫代磷酰胺、焦磷酸酯、硫代焦磷酸酯和焦磷酰胺类等。乐果（B对）也是一种有机磷类药物。呋喃丹（D错，为本题正确答案）属于氨基甲酸酯类药物。